颏舌肌
A. 为成对的舌内肌
B. 起于下颌骨的颏隆凸
C. 止于舌的两侧面
D. 一侧收缩使舌伸向对侧
E. 两侧同时收缩拉舌向后

正确答案：D。一侧收缩使舌伸向对侧

解析：颏舌肌为成对的舌外肌，而非舌内肌（A错），起于下颌骨的颏棘，而非颏隆凸（B错），止于舌体中线两侧，而非舌的两侧面（C错），一侧收缩使舌伸向对侧（D对），两侧同时收缩拉舌向前下方，而非向后（E错）。